躯干和四肢意识性本体感觉和精细触觉传导通路，经内囊的神经纤维参与构成
A. 丘脑前辐射
B. 丘脑中央辐射
C. 视辐射
D. 听辐射
E. 额桥束

正确答案：B。丘脑中央辐射

解析：躯干和四肢意识性本体感觉和精细触觉传导通路中，第3级神经元的胞体在背侧丘脑的腹后内侧核，经内囊的神经纤维参与构成丘脑中央辐射（B对）。